在罩牙本质和透明层以内的牙本质称为
A. 管周牙本质
B. 管间牙本质
C. 前期牙本质
D. 球间牙本质
E. 髓周牙本质

正确答案：E。髓周牙本质

解析：在罩牙本质和透明层以内的牙本质称为髓周牙本质。掌握“牙本质”知识点。